关于基底核的正确描述是
A. 又称新纹状体
B. 包括尾状核、豆状核和杏仁体
C. 是大脑髓质中的灰质团块
D. 包括纹状体，屏状核
E. 组成边缘系统

正确答案：C。是大脑髓质中的灰质团块

解析：基底核是大脑髓质中的灰质团块（C对）；在种系发生上，尾状核和壳 是较新的结构，合称新纹状体（A错）；基底核包括纹状体、屏状核和杏仁体（BD错）；边缘系统（E错）由边缘叶及与其密切相联系的皮质下结构，如杏仁核、隔核、下丘脑、背侧 丘脑的前核和中脑被盖的一些结构等共同组成。